胃十二指肠溃疡外科手术的绝对适应证是
A. 溃疡病穿孔
B. 应激性溃疡
C. 瘢痕性幽门梗阻
D. 胃后壁溃疡
E. 溃疡病出血

正确答案：C。瘢痕性幽门梗阻

解析：胃十二指溃疡引起的幽门梗阻可分为炎症水肿性、痉挛性和瘢痕性三种，前两种是暂时的、可逆的，经胃肠减压、输液等非手术治疗使炎症消退、痉挛缓解后，幽门可恢复通畅，而溃疡反复发作形成的瘢痕梗阻是永久性的，需要外科手术才能解除，因此胃十二指肠溃疡外科手术的绝对适应证是瘢痕性幽门梗阻（C对）。溃疡病穿孔（A错）多采用手术治疗，但对于一般情况好，症状和体征较轻的空腹穿孔，可行胃肠减压、输液、全身应用抗生素、给予质子泵或H₂受体抑制剂等保守治疗。应激性溃疡（B错）指休克、创伤、大手术后和严重感染等应激状态下发生的一种急性胃黏膜病变，主要表现为上消化道出血，去除应激因素后，行补液、抗感染、应用抑酸及止血药物或内镜下止血等非手术治疗后出血大多可以控制，严重出血不能控制者可行手术治疗。胃后壁溃疡（D错）经规范的抑酸药和抗生素联合治疗后多可治愈，不需行外科手术治疗。大多数溃疡病出血（E错）可经非手术治疗止血，仅约10%的病人需要手术治疗。